男，24岁。间断咳嗽2天。伴阵发性胸闷，无痰，无发热、胸痛。查体：右下肺呼吸音稍低，未闻及干湿性啰音，为明确诊断，首选的检查是
A. 血D-二聚体
B. 胸部B超
C. 胸部X线片
D. 肺功能
E. 动脉血气分析

正确答案：B。胸部B超

解析：男，24岁，间断咳嗽2天，伴阵发性胸闷，无痰，无发热、胸痛（排除肺部感染性疾病），查体：右下肺呼吸音稍低（考虑胸腔积液可能性大），未闻及干湿性啰音，综上所述，该患者最可能的诊断是胸腔积液，X线胸片是用于发现胸腔积液的影像学方法（C错）。血D-二聚体（A错）、动脉血气分析（E错）对于胸腔积液无诊断意义。B超用于确定积液的位置、量（B对）。肺功能用于诊断COPD、哮喘（D错）。